提出‘以最大多数人的最大幸福’作为道德判断标准的学者是
A. 边沁
B. 密尔
C. 苏格拉底
D. 亚里士多德
E. 康德

正确答案：A。边沁

解析：伦理学的基本理论有美德论、义务论和效果论。其中，效果论又称目的论、功利论，是指主张利益是道德的基础。人具有趋利避害的本性，追求最大多数人的最大幸福就是善，因而应以行为的效用作为道德评价标准的伦理学理论。边沁（A对）是主张“以最大多数人的最大幸福”作为道德判断标准的学者，被称为功利论主义之父，密尔（B错）对边沁的功利论进行了批判性的修正。苏格拉底（C错）和亚里士多德（D错）是美德论的代表。康德（E错）是义务论的代表。